可做O/W型软膏乳化剂的是
A. 黄凡士林
B. 甘油
C. 羟苯乙酯
D. 月桂醇硫酸钠
E. 乙醇

正确答案：D。月桂醇硫酸钠

解析：本题考查乳膏剂的基质与附加剂。月桂醇硫酸钠（D对）是O/W软膏剂常用的乳化剂；黄凡士林（A错）属于油脂型基质；甘油（B错）、白凡士林为乳膏剂的保湿剂；羟苯乙酯（C错）为防腐剂；乙醇（E错）不含亲油基，不具有表面活性，不能做乳化剂。